环境质量评价方法的基本要素不包括
A. 监测数据
B. 评价参数
C. 评价标准和评价权重
D. 环境质量评价模型
E. 环境质量指数的设计原则

正确答案：E。环境质量指数的设计原则

解析：本题考查环境质量评价方法的基本要素。环境质量评价方法的基本要素包括：1.监测数据（A对）：监测数据是环境质量评价的基础；2.评价参数（B对）：即监测指标，环境要素是由监测指标来反映的；3.评价标准：评价标准是评判环境质量优劣程度的依据，也是评价环境质量对健康影响的依据；4.评价权重（C对）：在评价中对各评价参数或环境要素给予不同的权重以体现其在环境质量中的重要性；5.环境质量评价模型（D对）：可以分为指数模型、分级模型等。环境质量指数的设计原则（E错，为本题正确答案）不是环境质量评价方法的基本要素。